男，63岁。4年前开始出现记忆减退，近1年日益加重，不认识女儿，捡废旧物品，出门找不到家，不会穿衣，常呆坐、呆立、呆望，不言不语，对人冷淡，不关心家人。既往有冶游史。躯体神经系统检查无异常。精神检查：意识清，定向障碍，记忆障碍，个位数计算正确，两位数加法常错，夜间不眠，到处摸索，说身边有人唱歌，内容听不清，流露出悲观情绪，未见自杀行为，生活不能自理。化验：康华试验阴性，CSF正常，CT：脑萎缩，额颞叶明显。最可能诊断是
A. 老年性痴呆
B. 脑血管性痴呆
C. 脑肿瘤
D. 麻痹性痴呆
E. 正常压力脑积水所致痴呆

正确答案：A。老年性痴呆

解析：老年男性男性患者，记忆减退（记忆障碍），不认识女儿（失认），捡废旧物品，出门找不到家，不会穿衣，常呆坐、呆立、呆望，不言不语，对人冷淡，不关心家人（阿尔兹海默病常见临床表现），既往有冶游史，康华试验阴性（排除梅毒），精神检查：意识清，定向障碍，记忆障碍，个位数计算正确，两位数加法常错（计算力障碍），夜间不眠，到处摸索，说身边有人唱歌，内容听不清，流露出悲观情绪，未见自杀行为，生活不能自理，CSF正常，CT：脑萎缩，额颞叶明显（可排除脑器质性病变），根据患者病史、临床表现和体征，最可能的诊断是阿尔兹海默病（老年性痴呆）（A对）。